初产妇第一产程潜伏期延长是指潜伏期超过
A. 8小时
B. 10小时
C. 12小时
D. 14小时
E. 16小时

正确答案：E。16小时

解析：根据八版妇产科学和3版实用妇产科学：潜伏期延长是指潜伏期超过16小时（E对）。
根据九版妇产科学：初产妇>20小时、经产妇>14小时称为潜伏期延长。